与梗阻性黄疸检查结果符合的是
A. 血间接胆红素升高，直接胆红素正常
B. 尿胆原弱阳性，尿胆红素阴性
C. 尿含铁血黄素阳性
D. 血直接，间接胆红素均升高，尿胆原阳性
E. 血直接胆红素升高，尿胆原阴性

正确答案：E。血直接胆红素升高，尿胆原阴性

解析：梗阻性黄疸时，胆汁淤积，血清CB（结合胆红素，又称“直接胆红素（DBil）”）增加，由于胆红素的肠肝循环被阻断，尿胆原减少或阴性（E对）；血间接胆红素升高（又称为“非结合胆红素（UCB）”），直接胆红素正常主要见于溶血性黄疸（A错）；尿胆原弱阳性，尿胆红素阴性见于正常人（B错）；尿含铁血黄素阳性（Rous试验阳性）常见于阵发性血红蛋白尿等血管内溶血疾病（C错）；血直接，间接胆红素均升高，尿胆原阳性见于肝细胞性黄疸（D错），多由病毒性肝炎、肝硬化、中毒性肝炎、钩体病、败血症等致肝细胞严重损害的疾病引起。